医疗机构取得麻醉药品、第一类精神药品的购用印鉴卡，应当具备的条件之一是
A. 有专职的药品管理人员
B. 有获得特殊药品处方资格的执业医师
C. 有专门的药品储存设施
D. 有获得麻醉药品和第一类精神药品处方资格的执业医师
E. 不需要保证麻醉药品和精神药品安全储存设施和管理制度

正确答案：D。有获得麻醉药品和第一类精神药品处方资格的执业医师

解析：医疗机构取得印鉴卡应当具备下列条件：①有专职的麻醉药品和第一类精神药品管理人员；②有获得麻醉药品和第一类精神药品处方资格的执业医师；③有保证麻醉药品和第一类精神药品安全储存的设施和管理制度。掌握“麻醉、精神药品的使用及法律责任”知识点。